内分泌疾病定位诊断检查不包括
A. 磁共振成像
B. 放射性核素显影
C. B型超声
D. 静脉导管分段取血
E. 血清激素水平测定

正确答案：E。血清激素水平测定

解析：完整的内分泌疾病的诊断应包括功能诊断、定位诊断和病因诊断（P645）。血清激素水平测定是内分泌腺功能的直接证据，属于功能诊断（E错，为本题正确答案）；磁共振成像（A对）、放射性核素显影（B对）、B型超声（C对）、静脉导管分段取血（D对）都是内分泌疾病定位诊断检查。